女，35岁。2个月以前被诊断为“风湿性心瓣膜病”，心功能评估Ⅰ级。现欲拔除左下颌阻生智牙。下列论述中正确的是
A. 近期活动性心脏病，属拔牙禁忌证
B. 心功能障碍严重，属拔牙禁忌证
C. 易感染葡萄球菌，应于术前3天始予青霉素预防
D. 应在术前一小时口服青霉素预防感染
E. 预防感染治疗应从术前两天开始至术后三天

正确答案：D。应在术前一小时口服青霉素预防感染

解析：本题考查系统疾病对牙拔除术的影响及拔牙禁忌证。女，35岁。2个月以前被诊断为“风湿性心瓣膜病”，心功能评估Ⅰ级。现欲拔除左下颌阻生智牙。下列论述中正确的是应在术前一小时口服青霉素预防感染（D对）。风湿性心瓣膜病不属于拔牙禁忌证或暂缓拔牙情况（A错）。心脏病患者如心功能尚好，为Ⅰ或Ⅱ级，可以耐受拔牙及其他口腔小手术（B错）。引起细菌性心内膜炎的重要因素之一是绿色链球菌（甲型溶血性链球菌）菌血症（C错）。预防性使用抗生素是心瓣膜病患者接受口腔手术处理前所必需，阿莫西林术前1h口服为标准预防用药（D对E错）。